应用羟甲戊二酰辅酶A还原酶抑制剂（他汀类）治疗高脂血症时、停药指标为肌痛，且肌酸磷酸激酶（CPK）值高于正常值上限的
A. 2倍
B. 4倍
C. 6倍
D. 8倍
E. 10倍

正确答案：E。10倍

解析：本题考查调血脂药。调血脂药羟甲戊二酰辅酶A还原酶抑制剂（他汀类）治疗高脂血症时，对CPK升高至正常值10倍（E对）以上，转氨酶（AST及ALT）大于正常值3倍以上，就必须停药。